患者，女，39岁。阴道脱出一物3年；查：宫颈及部分宫体已脱出阴道口，诊断为子宫脱垂。其程度应属于
A. Ⅰ度轻
B. Ⅰ度重
C. Ⅱ度轻
D. Ⅱ度重
E. Ⅲ度

正确答案：D。Ⅱ度重

解析：Ⅱ度重型：宫颈及部分宫体已脱出阴道口（D对）；I度轻型∶子宫颈外口距处女膜缘<4cm，但未达处女膜缘（A错）；I度重型∶宫颈外口已达处女膜缘，在阴道口可见到宫颈（B错）；Ⅱ度轻型∶子宫颈已脱出阴道口，但宫体仍在阴道内（C错）；Ⅲ度∶子宫颈及宫体全部脱出至阴道口外（E错）。